矽肺的典型病理改变是
A. 肺气肿
B. 胸膜增生
C. 气胸
D. 结节型矽肺
E. 胸膜斑

正确答案：D。结节型矽肺